治疗外感发热，邪郁肌腠，项背强痛者，应首选
A. 荆芥
B. 白芷
C. 薄荷
D. 葛根
E. 柴胡

正确答案：D。葛根

解析：外感发热，治以发汗解表；邪郁肌腠，项背强痛，治以解肌退热。葛根具有解肌退热，透疹，生津止渴，升阳止泻的功效，能辛散发表以退热，缓解外邪郁阻、经气不利、筋脉失养所致的项背强痛（D对）。荆芥具有祛风解表，透疹消疮，止血的功效，为发散风寒药中药性最为平和之品，并没有解肌之功（A错）。白芷具有解表散寒，祛风止痛，通鼻窍，燥湿止带，消肿排脓的功效，祛风解表散寒之力较温和，而以止痛、通鼻窍见长，并没有解肌之功（B错）。薄荷具有疏散风热，清利头目，利咽透疹，疏肝行气的功效，是辛凉解表药中最能宣散表邪，具有一定发汗作用之药，为疏散风热常用之品，没有解肌之功（C错）。柴胡具有解表退热，疏肝解郁，升举阳气的功效，善于祛邪解表退热和疏散少阳半表半里之邪，没有解肌之功（E错）。